腹膜为全身面积最大的浆膜，薄而光滑，呈半透明状，壁腹膜和脏腹膜相互移行围成一浆膜腔，称腹膜腔。腹膜有分泌、吸收、支持、固定、修复和防御等功能。腹膜从腹、盆壁移行于脏器或脏器间相互移行形成许多结构，主要有网膜、系膜、韧带和陷凹等。关于腹膜腔的描述，正确的是
A. 男性通过腹腔口与外界间接相通
B. 女性是密闭的
C. 腹膜腔内没有浆液
D. 脏、壁腹膜互相延续移行围成腹膜腔
E. 腹膜内位器官位于腹膜腔内，腹膜外位器官位于腹膜腔外

正确答案：D。脏、壁腹膜互相延续移行围成腹膜腔

解析：男性腹膜腔封闭(A错)，女性腹膜腔通过腹腔口等结构与外界相通(B错)，腹膜腔内有少量浆液(C错)，脏、壁腹膜互相延续移行，共同围成腹膜腔(D对)，腹膜内位器官为几乎全被腹膜覆盖的器官，腹膜外位器官为仅一面被腹膜覆盖的器官(E错)。